影响F和Kₐ的制剂因素不包括
A. 药物的理化性质
B. 药物的各种剂型
C. 处方中的辅料
D. 制剂的工艺过程
E. 药物的相互作用

正确答案：E。药物的相互作用